久嗽寒痰重，咯泡沫样痰，畏寒者，可在主方中加用
A. 法半夏、厚朴
B. 沙参、百合
C. 甘草、桔梗
D. 党参、白术
E. 干姜、细辛

正确答案：E。干姜、细辛

解析：久嗽寒痰重，咯泡沫样痰，畏寒者为寒饮咳喘，应加用有温肺化饮功效的药物。干姜辛热温散。入脾、胃经，既祛脾胃寒邪，又助脾胃阳气，为温中散寒之要药，无论实寒、虚寒证皆宜。入心经，能回阳通脉，常配附子治亡阳欲脱。入肺经，能温肺化饮，治寒饮咳喘常投。细辛芳香气浓，辛温走窜，入心、肺、肾经，通彻表里上下，有小毒而力较强。善祛风散寒、通窍止痛，为治风寒、风湿所致诸痛及鼻渊鼻塞头痛之良药。能温散肺寒、化痰饮，为治寒饮伏肺之要药。最宜治疗少阴头痛、鼻渊与牙痛。（E对）。法半夏、厚朴（A错）性温燥，均有燥湿化痰之功，但无法治疗畏寒症状。沙参、百合（B错）均为补阴药，性寒凉，加用会加重病情。甘草、桔梗（C错），党参、白术（D错）并无治疗咳嗽之功效。